复方川贝精片适用于
A. 风热咳嗽
B. 肺热咳嗽
C. 风寒咳嗽
D. 阴虚咳嗽
E. 痰湿咳嗽

正确答案：C。风寒咳嗽

解析：本题考查的是复方川贝精片的主治。复方川贝精片适用于风寒咳嗽（C对）。复方川贝精片：【主治】用于风寒咳嗽、痰喘引起的咳嗽气喘等。川贝止咳露：【主治】风热咳嗽（A错），痰多上气或燥咳。蛇胆川贝胶囊：【主治】肺热咳嗽（B错），痰多。养阴清肺膏：【主治】阴虚燥咳（D错），咽喉干痛，干咳少痰，或痰中带血。桂龙咳喘宁胶囊：【主治】外感风寒，痰湿内阻引起的咳嗽（E错）、气喘、痰涎壅盛；急、慢性支气管炎见上述证候者。